患者，男，38岁。有溃疡病史，近2周来时常出现食后上腹部疼痛，无节律性，昨日酒后症状加重，近日晨起呕吐，呕吐物为大量宿食。应首先考虑的是
A. 多发性胃溃疡
B. 十二指肠球部溃疡
C. 十二指肠球后部溃疡
D. 幽门部溃疡并发幽门梗阻
E. 胃溃疡恶变

正确答案：D。幽门部溃疡并发幽门梗阻

解析：患者有溃疡病史，因酒后出现呕吐，呕吐物为大量宿食，应首先考虑的是幽门部溃疡并发幽门梗阻（D对）。胃溃疡（A错）多表现为餐后1小时上腹痛。十二指肠球部溃疡（B错）表现为两餐间疼痛，食后缓解。球后溃疡（C错）除具有十二指肠溃疡特点外，以夜间痛及背部放射痛多见。胃溃疡恶变（E错）有消化道症状伴消瘦、乏力。